由研究者控制干预措施的研究为
A. 现况研究
B. 病例对照研究
C. 队列研究
D. 实验流行病学
E. 理论流行病学

正确答案：D。实验流行病学

解析：本题考查实验流行病学。实验流行病学（D对ABCE错）是指研究者根据研究目的，按照预先确定的研究方案将研究对象随机分配到实验组和对照组，人为地施加或减少某种处理因素，然后追踪观察处理因素的作用结果，比较和分析两组人群的结局，从而判断处理因素的效果。